新小脑的传入纤维来自
A. 齿状核
B. 前庭核
C. 红核
D. 脑桥核
E. 无

正确答案：D。脑桥核

解析：新小脑的传入纤维来自脑桥核（D对）。齿状核（A错）位于小脑半球的白质内，属于新小脑；前庭核（B错）位于延脑上段的背外侧区，接受来自前庭感受器传入的有关身体姿势、平衡和加速度的本体感觉；红核（C错）位于中脑上丘高度的被盖中央部，黑质的背内侧，从上丘下界向上伸入间脑尾部。